当某一新疗法可防止死亡但不影响疾病恢复时，那么将会发生
A. 该病发病率增加
B. 患病减少
C. 该病患病率增加
D. 该病发病率降低
E. 发病和患病均减少

正确答案：C。该病患病率增加

解析：本题考查影响患病率升高的因素。引起患病率升高（C对ABDE错）的主要因素包括：①新病例增加；②治疗水平提高，病人免于死亡，但未痊愈，病程延长；③未治愈者的寿命延长；④病例迁入；⑤健康者迁出；⑥易感者迁入；⑦诊断水平提高；⑧报告率提高。